《中国居民膳食指南（2016）》提出每人每日食盐摄入量不超过
A. 4.0g
B. 5.0g
C. 6.0g
D. 7.0g
E. 8.0g

正确答案：C。6.0g

解析：本题考查《中国居民膳食指南（2016）》提出的每人每日食盐摄入量。《中国居民膳食指南（2016）》提出每人每日食盐摄入量不超过6.0g（C对ABDE错）。